关于气雾剂和喷雾剂质量要求的说法，正确的有
A. 喷雾剂应避光密封贮存
B. 气雾剂应置凉暗处贮存
C. 喷雾剂应进行喷射速率的检查
D. 气雾剂应进行泄漏检查
E. 定量气雾剂喷出的雾滴（粒）应均匀

正确答案：A、B、D、E。喷雾剂应避光密封贮存；气雾剂应置凉暗处贮存；气雾剂应进行泄漏检查；定量气雾剂喷出的雾滴（粒）应均匀

解析：本题考查气雾剂和喷雾剂的质量要求。下列关于气雾剂和喷雾剂质量要求的说法，正确的有喷雾剂应避光密封贮存（A对）、气雾剂应置凉暗处贮存（B对）、气雾剂应进行泄漏检查（D对）、定量气雾剂喷出的雾滴（粒）应均匀（E对）。气雾剂、喷雾剂生产与贮藏的有关规定：定量气雾剂释出的主药含量应准确，喷出的雾滴（粒）应均匀，吸入气雾剂应保证每揿含量的均匀性。制成的气雾剂应进行泄漏检查，确保使用安全。喷雾剂应避光密封贮存。气雾剂应置凉暗处贮存，并避免暴晒、受热、敲打、撞击。喷射速率：非定量气雾剂每瓶的平均喷射速率（g/s），均应符合各品种项下的规定（C错）。